雷公藤有大毒，作用力强，其功效不包括
A. 祛风除湿
B. 活血通络
C. 消肿止痛
D. 利水消肿
E. 杀虫解毒

正确答案：D。利水消肿

解析：本题考查的是雷公藤的功效。雷公藤有大毒，作用力强，其功效不包括利水消肿（D错，为本题正确答案）。雷公藤：【功效】祛风除湿（A对），活血通络（B对），消肿止痛（C对），杀虫解毒（E对）。利水消肿为香加皮的功效。香加皮：【功效】祛风湿，强筋骨，利水消肿。